蝉蜕的功效是
A. 息风止痉
B. 平肝明目
C. 消肿疗疮
D. 凉血止血
E. 升阳止泻

正确答案：A。息风止痉

解析：本题考查的是蝉蜕的功效。蝉蜕的功效是息风止痉（A对）。蝉蜕：【功效】疏散风热，透疹止痒，明目退翳，息风止痉。桑叶：【功效】疏散风热，清肺润燥，平肝明目（B错），凉血止血（D错）。牛蒡子：【功效】疏散风热，宣肺利咽，解毒透疹，消肿疗疮（C错）。葛根：【功效】解肌退热，透疹，生津，升阳止泻（E错）。